下列不属于二次文献的是
A. 《中国药学文摘》（CPA）
B. 《中国药学杂志》
C. 《国际药学文摘》（IPA）
D. 《医学文摘》（EM）
E. 《医学索引》（IM）

正确答案：B。《中国药学杂志》

解析：本题考查药物信息的分类。《中国药学杂志》（B错，为本题正确答案）属于一次文献而不是二次文献。药学信息按照其最初来源通常分为三级：一级信息资源（一次文献）即原创性论著，包括实验研究结果、病例报道以及评价性的或描述性的科学研究结果；二级信息资源（二级文献）是对原创性论著进行加工，主要用于检索一级文献，一般由引文书目组成，可提供摘要、引文、索引（包括或不包括全文）及目录。文摘数据库或全文数据库是获取文献信息的常用二级信息资源，如《中国药学文摘》（CPA）（A对）、《国际药学文摘》（IPA）（C对）、《医学文摘》（EM）（D对）、《医学索引》（IM）（E对）等；三级信息资源（三次文献）是在一级、二级文献的基础上归纳、综合、整理后的结果，包括医药图书（工具书、教科书、手册等）、光盘或在线数据库等。